根据释药类型，按生物时间节律特点设计的口服缓控释制剂是
A. 定速释药系统
B. 胃定位释药系统
C. 小肠定位释药系统
D. 结肠定位释药系统
E. 包衣脉冲释药系统

正确答案：E。包衣脉冲释药系统

解析：本题考查缓（控）释制剂。根据制备技术不同，按生物时间节律特点设计的口服缓控释制剂可分为渗透泵脉冲释药系统、包衣脉冲释药系统（E对）和定时脉冲塞胶囊等。根据释药类型分为：口服缓释、控释制剂。口服缓释、控释制剂可以分为定速（A错）、定位、定时释药系统。胃定位释药系统（B错）、小肠定位释药系统（C错）、结肠定位释药系统（D错）为定位释药。